男性，35岁，劳力性呼吸困难，心悸，气短，少尿，下肢浮肿1年余，1周前咽痛、咳嗽、咯黄痰后呼吸困难加重，夜间不能平卧。超声心动图示，左右心室扩张，弥漫性运动不良，左心室射血分数30%。口服地高辛0.25mg，1次/d，既往无任何特殊病史。导致近期病情加重的原因是
A. 感染
B. 过劳
C. 电解质紊乱
D. 心肌炎症
E. 洋地黄中毒

正确答案：A。感染

解析：出现感染（咽痛、咳嗽、咯痰）后病情加重。掌握“心力衰竭”知识点。